不正确的论述是
A. 凡能释放出H⁺的化学物质称为酸
B. 一个酸总是与相应的碱形成一个共轭体系
C. Pr-是一种碱
D. 凡能接受H⁺的化学物质称为碱
E. SO2⁻、NH4⁺是酸

正确答案：E。SO2⁻、NH4⁺是酸

解析：凡能释放出H⁺的化学物质称为酸（A对），能接受H+的化学物质称为碱（D对），一个化学物质作为酸释放出H+，必然有一个碱性物质形成，因此，一个酸总是与相应的碱形成一个共扼体系（B对）。Pr-和SO2⁻都能接受H+形成HPr或H2SO4，所以Pr-和SO2⁻都是碱（C对E错，为本题正确答案），NH4⁺由于能释放出H+，所以是酸。